卡托普利（巯甲丙脯酸）机制
A. 抑制肾素的合成
B. 抑制肾素的释放
C. 抑制血管紧张素I合成酶
D. 抑制血管紧张素转化酶
E. 以上均非

正确答案：D。抑制血管紧张素转化酶

解析：卡托普利属于血管紧张素Ⅰ转化酶抑制剂（ACEI），通过抑制血管紧张素转化酶（ACE）（D对CE错）使血管紧张素Ⅰ转化为血管紧张素Ⅱ减少，从而扩张血管，降低血压，抑制肾脏组织中醛固酮的生成，减轻水钠潴留而降低血压，抑制缓激肽水解，扩张血管，抑制血管紧张素Ⅱ对血管和心肌的细胞生长因子的促进作用，减轻或逆转心肌和血管重构。肾素可催化血管紧张素原转化形成血管紧张素Ⅰ，肾素抑制药则通过降低肾素活性，进而抑制血管紧张素Ⅰ的形成，降低血压，常用的肾素抑制药为瑞米吉仑，卡托普利不影响肾素的合成和释放（AB错）。